肝细胞气球样变
A. 细胞水肿
B. 脂质沉积
C. 结缔组织玻璃样变
D. 血管壁玻璃样变
E. 细胞内玻璃样变

正确答案：A。细胞水肿

解析：肝细胞气球样变是指病毒性肝炎时，肝细胞水肿（A对）进一步发展，导致细胞体积更加肿大，由多角形变为圆球形，胞质几乎透明。肝细胞内脂质沉积（B错）过多可引起脂肪肝。结缔组织玻璃样变（C错）、血管壁玻璃样变（D错）和细胞内玻璃样变（E错）为玻璃样变（P16）的三种不同分类，是指细胞内或间质中出现半透明状蛋白质蓄积。